炎症时血小板激活因子的作用不包括
A. 促进白细胞吞噬
B. 激活血小板
C. 对白细胞有趋化作用
D. 促进白细胞聚集和黏着
E. 使血管通透性增加

正确答案：A。促进白细胞吞噬

解析：炎症时血小板激活因子的作用包括激活血小板（B对）、趋化白细胞（C对）、促进白细胞聚集和黏着（D对）、使血管通透性增加（E对）等，无促进白细胞吞噬（A错，为本题正确答案）的作用。